关于H锉下列哪项说法不正确
A. 横截面呈逗点状
B. 适用于宽松根管的预备
C. 刃口与根管壁接近垂直
D. 操作时可用旋转和提拉动作
E. 较易折断

正确答案：D。操作时可用旋转和提拉动作

解析：本题考查根管预备器械-H锉。普通的锉一般都可旋转切削牙本质，而H锉不一样，H锉切刃与根管壁接近垂直的特性也是其不能旋转（D错，为本题正确答案）的原因，若强行旋转则较易折断（E对）。H锉切削能力强主要用来切削根管壁的软化牙本质。H锉横截面呈逗点状（A对），旋转角为60°～65°。H锉易卡嵌在狭窄根管内，适用于宽松根管的预备（B对）。H锉切刃锋利，与根管壁接近垂直（C对），因此提拉动作可高效切削牙本质。